患者，女性，50岁，因上颌窦癌行上颌骨全切除术，口腔内创面需行游离植皮术，在右大腿取皮。关于供区创面的处理，正确的是
A. 严密缝合敷料覆盖创面
B. 创面暴露，任其自然恢复
C. 采用邻近组织瓣滑行覆盖关闭创面
D. 创面行点状异体皮移植
E. 覆盖油纱即敷料绷带加压包扎

正确答案：E。覆盖油纱即敷料绷带加压包扎

解析：本题考查供区创面的处理。由于供区创面可痊愈，只需用敷料绷带加压包扎（E对），隔绝外界感染，为创面的痊愈提供一个无污染的环境。此患者是在右大腿取厚中厚皮片移植，供区创面不用严密缝合（A错），视供皮厚度，可在2-3周内痊愈，只需用敷料覆盖创面即可。若创面暴露，让其与外界接触，则易发生感染，不利于其自然恢复（B错）。无需用邻近组织瓣滑行覆盖关闭创面（C错），否则又会形成新的创面。创面行点状异体皮移植（D错），皮片不仅不能存活，多此一举，且会引起创面的感染。